关于磨牙的髓腔形态正确的是
A. 上6的近远中径＞颊舌径＞髓室高度
B. 下6的颊舌径＞近远中径＞体室高度
C. 上6的近远中径＞髓室高度＞颊舌径
D. 上6的颊舌径＞近远中径＞髓室高度
E. 下6的颊舌径＞髓室高度＞近远中径

正确答案：D。上6的颊舌径＞近远中径＞髓室高度

解析：本题考查上颌磨牙的髓腔形态。关于磨牙的髓腔形态正确的是上6的颊舌径＞近远中径＞髓室高度（AC错D对）。上6即上颌第一磨牙，髓室顶形凹，最凹处约与颈缘平齐。髓室顶上近颊髓角和近舌髓角较高，二者均接近牙冠中1/3；远颊髓角和远舌髓角较低，均接近牙冠颈1/3处。下颌第一磨牙即下6，髓室约呈矮立方形，近远中径＞颊舌径＞髓室高度（约1mm）（BE错）；髓室顶形凹，最凹处约与颈缘平齐，近舌髓角与远舌髓角高度相近，两者均接近牙冠中1/3。近颊髓角、远颊髓角和远中髓角较低，位于牙冠颈1/3或颈缘附近。